要使一个人的行为发生改变，起决定作用的因素是
A. 内因
B. 外因
C. 环境
D. 促成
E. 强化

正确答案：A。内因